雌二醇的适应证是
A. 子宫颈癌
B. 绝经期前乳腺癌
C. 前列腺癌
D. 子宫内膜癌
E. 子宫癌

正确答案：C。前列腺癌

解析：本题考查雌二醇的适应证。雌二醇属于雌激素，可用于功能性子宫出血、原发性闭经、绝经期综合征以及前列腺癌（C对）等。子宫颈癌（A错）、乳腺癌（B错）、子宫内膜癌（D错）及子宫癌（E错）均不能用雌二醇治疗。